除另有规定外，研粉口服用贵细饮片，每10g不得检出的是
A. 霉菌
B. 沙门菌
C. 酵母菌
D. 需氧菌
E. 大肠埃希菌

正确答案：B。沙门菌

解析：本题考查的是研粉口服用贵细饮片的微生物限度。除另有规定外，研粉口服用贵细饮片，每10g不得检出的是沙门菌（B对）。微生物限度：每1g供试品中需氧菌（D错）总数不得过1000cfu、霉菌（A错）及酵母菌（C错）数不得过100cfu、不得检出大肠埃希菌（E错），每10g供试品中不得检出沙门菌。